中国药典规定“精密称定”时，系指重量应准确在所取重量的
A. 百分之一
B. 千分之一
C. 万分之一
D. 百分之十
E. 千分之三

正确答案：B。千分之一

解析：本题考查中国药典的凡例。中国药典规定“精密称定”时，系指重量应准确在所取重量的千分之一（B对）。“精密称定”指称取重量应准确至所取重量的千分之一（CDE错）。“称定”指称取重量应准确至所取重量的百分之一（A错）。